引起血清钙离子浓度降低的因素是
A. 降钙素分泌增多
B. 血pH值升髙
C. 血磷降低
D. 甲状旁腺功能亢进
E. 以上选项均不正确

正确答案：A。降钙素分泌增多

解析：降钙素（CT）（八版生理学P401）是由甲状腺C细胞合成的由32个氨基酸残基组成的多肽，其作用靶器官为骨和肾；CT通过抑制破骨细胞的活性、激活成骨细胞，促进骨盐沉积，从而降低血钙和血磷含量；CT还抑制肾小管对钙、磷的重吸收。CT的总体作用是降低血钙和血磷，引起血清钙离子浓度降低的因素是降钙素分泌增多（A对）。